当牙槽突很矮，牙根又很长时，其根尖部脓液可自鼻腔内排脓的牙是
A. 上颌第二双尖牙
B. 上颌第一双尖牙上颌尖牙
C. 上颌尖牙
D. 上颌中切牙
E. 上颌侧切牙

正确答案：D。上颌中切牙

解析：本题考查急性化脓性根尖周炎的排脓途径。当牙槽突很矮，牙根又很长时，其根尖部脓液可自鼻腔内排脓的牙是上颌中切牙（D对）。根尖周炎可通过三种方式排脓：（1）通过骨髓腔突破骨膜、黏膜或皮肤向外排脓的4条途径：①穿通骨壁突破黏膜：牙槽骨唇、颊侧的骨壁较薄，一般情况下上颌前牙、上颌后牙颊根，以及下颌牙的根尖周脓肿多从牙槽骨的唇、颊侧骨板穿出，形成骨膜下脓肿或黏膜下脓肿，最终在口腔前庭排脓。②穿通骨壁突破皮肤：有少数病例根尖部的脓液不在口腔内排脓，而是穿通骨壁绕过龈颊沟从皮肤排出，久之形成皮窦。如下颌切牙的根尖周脓肿有时可穿通颏部皮肤，形成颏窦；上颌尖牙可见有从同侧眼眶的内下方皮肤排脓，形成面窦；下颌磨牙的根尖部脓液也可排放于颊部皮肤，形成颊窦。③突破上颌窦壁：上颌前磨牙和磨牙牙根与上颌窦相毗邻，当上颌窦处于低位时，上述牙尤其是上颌第二前磨牙和第一、第二磨牙的根尖部分就可能被包裹在上颌窦当中，此处的上颌窦壁极薄，甚至缺乏骨板，根尖与上颌窦之间只有薄层结缔组织相隔。此时它们若发生根尖周炎，可累及上颌窦并发上颌窦炎，根尖部的脓液有可能穿通薄层上颌窦壁向上颌窦内排脓，这种情况在临床上较为少见。④突破鼻底黏膜：当上颌中切牙的牙槽突很短而牙根又很长时，其根尖部的脓液排放有可能在穿通唇侧骨壁后，继续沿骨膜上行而流注于鼻底黏膜下形成脓肿，破溃后向鼻腔内排脓，这是一种极为罕见的排脓途径。（2）通过根尖孔从冠部缺损处排脓，这种排脓途径破坏最小。（3）通过牙周膜从龈沟或牙周袋排脓，这种方式通常较差。